教育是人社会化的过程和手段，其中与健康关系最直接的内容是
A. 教育水平
B. 生活技能的培养
C. 价值观
D. 健康观
E. 消费结构

正确答案：B。生活技能的培养